下列哪项不是潜伏期的流行病学意义
A. 确定接触者的留验、检疫和医学观察时限
B. 确定免疫接种时间
C. 推断患者受感染的时间
D. 评价预防效果好坏
E. 判断传染病传染力的大小

正确答案：E。判断传染病传染力的大小